26岁经产妇，停经8周，下腹阵发性剧烈疼痛10小时伴多量阴道流血，超过月经量，检查宫口开大近2cm。本例最恰当的处置应是
A. 静脉滴注止血药物
B. 口服硫酸舒喘灵
C. 肌注硫酸镁
D. 肌注黄体酮
E. 行负压吸宫术

正确答案：E。行负压吸宫术

解析：育龄女性患者，停经8周（早期流产发生在妊娠12周前），下腹阵发性剧烈疼痛伴多量阴道流血（难免流产时阴道流血量增多，阵发性下腹痛加剧），宫口开大近2cm（难免流产时宫口已扩张），应诊断为难免流产。一旦确诊，应尽早使胚胎及胎盘组织完全排出，最恰当的处置是行负压吸宫术（E对）。静脉滴注止血药物（A错）不能阻止流产性阴道出血。口服硫酸舒喘灵（B错）、肌注硫酸镁（P61）（C错）具有抑制宫缩的作用，用于延长先兆早产患者（孕周满28周至不足37周）的孕周。肌注黄体酮（D错）用于黄体功能不全引起的先兆流产患者。